关于上腔静脉何种说法对
A. 注入左心房
B. 注入右心房
C. 由头静脉和腋静脉汇合成
D. 由颈内静脉和锁骨下静脉汇合成
E. 无

正确答案：B。注入右心房

解析：上腔静脉注入右心房（B对A错）。由左、右头臂静脉汇合而成（CD错）。